能部分代谢成吗啡，而产生成瘾性的药物是
A. 盐酸纳洛酮
B. 酒石酸布托啡诺
C. 右丙氧芬
D. 苯噻啶
E. 磷酸可待因

正确答案：E。磷酸可待因